骨质软化症是由于缺乏哪种维生素
A. 维生素A
B. 维生素B₁
C. 维生素C
D. 维生素D
E. 维生素E

正确答案：D。维生素D